多种不同抗抑郁药治疗失败者，宜选用
A. 帕罗西汀
B. 阿米替林
C. 度洛西汀
D. 文拉法辛
E. 吗氯贝胺

正确答案：D。文拉法辛

解析：本题考查抑郁症的药物治疗。对多种不同抗抑郁药治疗失败者，可选用5-羟色胺及去甲肾上腺素再摄取抑制药文拉法辛（D对）。